对肛管直肠癌有重要意义的简易诊断方法是
A. X线摄片
B. 肛门直肠指诊
C. 病理检查
D. 美蓝染色
E. 纤维结肠镜检查

正确答案：B。肛门直肠指诊

解析：肛管直肠癌，中医称之为锁肛痔，是发生在肛管直肠的恶性肿瘤，病至后期，肿瘤阻塞，肛门狭窄，排便困难，其早期特点为便血、大便习惯改变，肛门直肠指诊，是诊断直肠癌的最重要方法，80%的直肠癌位于手指可触及的部位，可以清楚地扪到肠壁上的硬块、巨大溃疡或肠腔狭窄，简单易行（B对）。X线摄片不适用于肛管直肠癌的诊断（A错）。病理检查，可确诊肛管直肠癌，但是在直肠镜或乙状结肠镜检查的基础上取活组织进行，较为复杂，不符合题意（C错）。美蓝染色适用于标本组织染色（D错）。纤维结肠镜检查部位为结肠（E错）。